以下有关沟纹舌的描述中，恰当的一项是
A. 较深的沟内易积存食物、细菌
B. 舌黏膜颜色改变
C. 舌黏膜质地改变
D. 影响舌的活动度
E. 影响舌的味觉

正确答案：A。较深的沟内易积存食物、细菌

解析：沟纹舌沟纹的深浅、长短、粗细不一，并不影响舌的活动度和味觉，颜色正常，仍有一定的柔软度，舌乳头亦正常。较深的沟纹中常有细菌，食物残屑滞留而呈轻度炎症，如有水肿则舌体增大，严重者整个舌背布满裂纹。掌握“地图舌、沟纹舌及舌乳头炎”知识点。